与气的生成密切相关的脏腑是
A. 肝脾胃肾
B. 心肺胃肾
C. 心肝脾胃
D. 肺胃肝肾
E. 肺脾胃肾

正确答案：E。肺脾胃肾

解析：肾为生气之根、脾胃为生气之源、肺为生气之主，故气的生成与肺脾胃肾关系密切（E对）。肝主藏血，与气的生成无关（ACD错）；心主血脉，与气的生成无关（B错）。